可以作为一个客观依据留存的方法
A. 会谈法
B. 观察法
C. 作品分析法
D. 心理测验法
E. 调查法

正确答案：C。作品分析法

解析：作品分析法：也称产品分析法。所谓“作品”指被评估者所作的日记、书信、图画、工艺等文化性的创作，也包括了他（她）生活和劳动过程中所做的事和东西。通过分析这些作品（产品）可以有效地评估其心理水平和心理状态，并且可以作为一个客观依据留存。掌握“心理评估概述”知识点。